外釉上皮与成釉器的哪层上皮的延续处称为颈环
A. 外釉上皮
B. 内釉上皮
C. 星网状层
D. 中间层
E. 成牙本质细胞层

正确答案：B。内釉上皮

解析：本题考查牙胚的发生及分化。成釉器帽状期时其凹陷面与间充质相邻的内釉上皮与外釉上皮相延续，内釉上皮（B对）延续处称为颈环。